炮制后能缓和燥性和酸性，增强健胃消胀作用的药物是
A. 苍术
B. 斑蝥
C. 白术
D. 马钱子
E. 枳壳

正确答案：E。枳壳

解析：本题考查枳壳的炮制作用。炮制后能缓和燥性和酸性，增强健胃消胀作用的药物是枳壳（E对）。枳壳【炮制作用】枳壳味苦、辛、酸，性温。归脾、胃经。具有理气宽中、消滞除胀的功能。①枳壳辛燥，作用较强，偏于行气宽中除胀。用于气实壅满所致之脘腹胀痛或胁肋胀痛，瘀滞疼痛；子宫下垂，脱肛，胃下垂。②麸炒枳壳可缓和其峻烈之性，偏于理气健胃消食。用于宿食停滞，呕逆嗳气，风疹瘙痒。麸炒枳壳因其作用缓和，适宜于年老体弱而气滞者。苍术（A错）【炮制作用】苍术味辛、苦，性温。归脾、胃、肝经。具有燥湿健脾，祛风，散寒，明目的功能。①生苍术温燥面辛烈，燥湿，祛风，散寒力强。用于风湿痹痛，肌肤麻木不仁，腰膝疼痛，风寒感冒，肢体疼痛，湿温发热，肢节酸痛。②麸炒苍术辛味减弱，燥性缓和，气变芳香，增强了健脾和胃的作用，用于脾胃不和，痰饮停滞，脘腹痞满，青盲，雀目。③焦苍术辛燥之性大减，以固肠止泻为主。用于脾虚泄泻，久痢，或妇女的淋带白浊。斑蝥（B错）【炮制作用】斑蝥味辛，性热；有大毒。归肝、胃、肾经。具有破血消癥，攻毒蚀疮的功能。①生斑蝥多外用，毒性较大，以攻毒蚀疮为主。用于瘰疬瘘疮，痈疽肿痛，顽癣瘙痒。②米炒斑蝥毒性降低，其气味得到矫正，可内服。以通经、破癥散结为主。用于经闭癥瘕，狂犬咬伤，瘰疬，肝癌，胃癌。白术（C错）【炮制作用】白术味甘、苦，性温。归脾、胃经。具有健脾益气，燥湿利水，止汗，安胎的功能。①白术以健脾燥湿、利水消肿为主，生品与炒品相比祛湿力强，用于脾虚食少，腹胀泄泻，痰饮眩悸，水肿，自汗，胎动不安。②土炒白术，借土气勒健脾气，长于补脾止泻而安胎，用于脾虚食少、泄泻便溏、胎动不安。③麸炒白术，借麸味甘入中之性，以缓和白术的燥性，增其健脾之功，并兼消胀之能，用于脾气虚弱、中焦不和、运化失常所致的食少胀满、倦怠乏力。马钱子（D错）【炮制作用】马钱子味苦，性温；有大毒。归肝、脾经。具有通络止痛、散结消肿的功能。①生马钱子毒性剧烈，而且质地坚硬，仅供外用。常用于局部肿痛或痈疽初起。②制马钱子毒性降低，质地酥脆，易于粉碎，可供内服，常制成丸散剂应用。多用于风湿痹痛，跌打损伤，骨折瘀痛，痈疽疮毒，瘰疬，痰核，麻木瘫痪。